卵巢性激素以胆固醇为原料的合成途径，正确是
A. 雄激素→雌激素→孕激素
B. 雌激素→孕激素→雄激素
C. 孕激素→雄激素→雌激素
D. 雌激素→雄激素→孕激素
E. 孕激素→雌激素→雄激素

正确答案：C。孕激素→雄激素→雌激素

解析：在黄体生成素的刺激下，卵泡膜细胞内胆固醇经线粒体内细胞色素P450侧链裂解酶催化，形成孕烯醇酮，孕烯醇酮或通过先合成脱氢表雄酮再合成雄烯二酮，或通过先合成孕酮再合成雄烯二酮，雄烯二酮再转化为睾酮，再由睾酮转变为雌二醇，即孕激素→雄激素→雌激素（C对）。